腰痛湿热腰痛证，其中医治法是
A. 散寒行湿，发汗解表
B. 清热利湿，利水通淋
C. 活血化瘀，理气止痛
D. 清热利湿，舒筋止痛
E. 散寒行湿，温经通络

正确答案：D。清热利湿，舒筋止痛

解析：湿热邪气侵袭腰部，筋脉拘急，气血阻滞：湿热壅于腰部，筋脉弛缓，经气不通，故腰部弛痛而伴有热感。热天或雨天热重湿增，故疼痛加重，活动后气机稍有舒展，湿滞得减，故痛或可减轻，故湿热腰痛的治疗原则为清热利湿，舒筋止痛（D对）。活血化瘀，理气止痛是瘀血腰痛的治疗原则（C错）。散寒行湿，温经通络为寒湿腰痛的治疗原则（E错）。